正确描述肱尺关节的是
A. 关节面由肱骨滑车和尺骨的滑车切迹(半月切迹)构成
B. 围绕矢状轴可作收展运动
C. 围绕垂直轴可作旋转运动
D. 肱骨滑车的外侧唇比内侧唇低
E. 其屈伸运动围绕典型的冠状轴进行

正确答案：A。关节面由肱骨滑车和尺骨的滑车切迹(半月切迹)构成

解析：肱尺关节由肱骨滑车和尺骨滑车切迹构成（A对）。肱尺关节属于单轴关节，只能绕额状轴（E错）在矢状面内做屈伸运动（BC错）。